硬膜下隙
A. 位于硬脊膜与蛛网膜之间
B. 位于蛛网膜与软脊膜之间
C. 位于硬脊膜的外面
D. 位于蛛网膜的内面
E. 无

正确答案：A。位于硬脊膜与蛛网膜之间

解析：脊髓的被膜由外向内为硬脊膜、脊髓蛛网膜和软脊膜。硬膜下隙是硬脊膜与蛛网膜之间的潜在间隙（A对）。而脊髓的蛛网膜与软脊膜之间（B错）的较宽阔的间隙称蛛网膜下隙 , 其内充满脑脊液。